病人男性，58岁，突然头疼呕吐，伴意识丧失30分钟。查体神志清楚，颈部抵抗，克氏征阳性。右侧眼睑下垂，右侧瞳孔4毫米，光反应消失。最好的诊断措施是
A. 腰椎穿刺
B. 脑电图
C. 视力检查
D. 头颅CT
E. 视神经孔像

正确答案：D。头颅CT

解析：患者已初步诊断为蛛网膜下腔出血（SAH），CT对于颅内早期出血敏感性很高，对于疑诊蛛网膜下腔出血的患者应首选头颅CT（D对）。蛛网膜下腔出血患者颅内压常增高，因此不宜做腰椎穿刺（A错），以免诱发脑疝。脑电图（B错）常用于癫痫的诊断，对蛛网膜下腔出血诊断意义不大。视力检查（C错）和视神经孔像（E错）只能作为对眼部症状的检查，对诊断仅有提示作用。